“冷处”所指温度范围是
A. -5℃～10℃
B. 2℃～4℃
C. 2℃～10℃
D. 10℃～30℃
E. 20℃～50℃

正确答案：C。2℃～10℃

解析：本题考查药品的贮存。标明在冷处贮存则应贮存在2℃～10℃（C对）环境中，一般药品贮存于室温10℃～30℃（D错）即可。